属于静脉注射脂肪乳剂中渗透压调节剂的是
A. 大豆油
B. 大豆磷脂
C. 甘油
D. 羟苯乙酯
E. 注射用水

正确答案：C。甘油

解析：本题考查注射剂常用附加剂。静脉注射脂肪乳处方分析：精制大豆油（A错）-油相，主药；精制大豆磷脂（B错）-乳化剂，注射用甘油（C对）-等渗调节剂，注射用水-溶剂。此处方中无羟苯乙酯（D错）。